引起输血后肝炎的病毒是
A. HAV
B. HIV
C. HCV
D. HDV
E. HEV

正确答案：C。HCV